诊断幽门梗阻最有价值的体征是
A. 振水音阳性
B. 肠鸣音亢进
C. 上腹部膨隆
D. 明显脱水
E. 上腹部固定压痛

正确答案：A。振水音阳性

解析：诊断幽门梗阻最有价值的体征是振水音阳性（A对），振水音阳性见于幽门梗阻或胃扩张。肠鸣音亢进（B错）见于机械性肠梗阻。上腹部膨隆（C错）、明显脱水（D错）和上腹部固定压痛（E错）可见于多种疾病，不具有特异性。